静态作业的特点是
A. 能量消耗水平高
B. 能量消耗水平不高
C. 能量消耗水平因人而异
D. 能量消耗水平不高，不易疲劳
E. 能量消耗水平不高，易疲劳

正确答案：E。能量消耗水平不高，易疲劳